通过细胞膜的主动变形将大分子或颗粒状药物摄入细胞内的过程是
A. 被动扩散
B. 主动转运
C. 促进扩散
D. 吞噬作用
E. 胞饮作用

正确答案：D。吞噬作用

解析：本题考查药物的转运方式。通过细胞膜主动变形将大分子或颗粒状药物摄入细胞内的过程为吞噬（D对）；被动扩散（A错）是顺浓度梯度的运输，不消耗能量；主动转运（B错）是借助生物膜载体，逆浓度梯度的转运；促进扩散（C错）是借助载体进行的被动转运；胞饮（E错）为细胞通过膜动转运摄取液体。